男，12岁。发热2天，伴头痛、神志不清1天，8月中旬来诊。查体：T39.5℃，神志不清，克氏征、布氏征（+）。实验室检查：血WBC16×10⁹/L。最可能的诊断是
A. 疟疾
B. 钩端螺旋体病
C. 流行性乙型脑炎
D. 流行性脑脊髓膜炎
E. 中毒型菌痢

正确答案：C。流行性乙型脑炎

解析：12岁男性患儿，8月中旬来诊（乙脑流行季节）；发热2天，伴头痛、神志不清1天，查体：提问39.5℃（高热），神志不清（出现中枢神经系统症状），克氏征、布氏征（+）（病理征阳性）；实验室检查：血WBC16×10⁹/L（白细胞总数增高），根据患儿的临床表现和实验室检查，最可能的诊断为流行性乙型脑炎（C对）。流行性乙型脑炎的病原体是流行性乙型脑炎病毒，传播媒介为蚊，好发于夏秋季。疟疾（A错）的病原体是人类疟原虫，临床上以反复发作的间歇性寒战、好热、继之出大汗后缓解为特点，伴头痛、全身酸痛、乏力、但神志清楚（八版传染病学P280）。钩端螺旋体病（B错）的病原体是钩端螺旋体，早期主要表现为全身感染中毒症状，中期（器官损伤期）表现因临床类型而异，脑膜脑炎型为起病后3～10天出现严重头痛、烦躁等脑膜炎症状以及嗜睡、神志不清、昏迷等脑炎表现，严重咳发生脑水肿、脑疝及呼吸衰竭（八版传染病学P255-256）。流行性脑脊髓膜炎（D错）的病原体是脑膜炎奈瑟菌，好发于冬春季，按病菌毒力、数量和机体免疫力高低，流脑病情复杂多变、轻重不一，有普通型、爆发型、慢性败血症型三种类型，普通型最常见，表现为上呼吸道炎症，继而引起菌血症或败血症，出现突发寒战高热、恶心和出血性皮疹，侵犯中枢神经系统时产生剧烈头痛、喷射性呕吐、颈强直等脑膜刺激征（P105）。中毒型菌痢（E错）的病原体是志贺杆菌（痢疾杆菌），常无明显的消化道症状而表现为全身中毒症状，临床主要以高热、休克、中毒性脑病为表现（P115）。